国家发布并实施的最新尘肺X线诊断标准适用于以下尘肺
A. 矽肺
B. 石棉肺
C. 炭黑尘肺
D. 铝尘肺
E. 以上所有

正确答案：E。以上所有

解析：本题考查肺尘埃沉着病（尘肺）的分类。肺尘埃沉着病根据X线胸片检查，病理解剖等，可以分为五大类，分别为长期吸入游离二氧化硅导致的矽肺，长期吸入石棉等结合二氧化硅导致的硅酸盐肺、长期吸入煤和石墨等导致的炭尘肺、长期吸入游离二氧化硅和其他粉尘导致的混合性尘肺以及吸入纤维化金属而导致的金属尘肺（E对ABCD错）。